影响生长发育的环境因素中哪一个是最重要的
A. 营养因素
B. 体育锻炼
C. 疾病
D. 环境污染
E. 社会心理因素

正确答案：A。营养因素

解析：本题考查影响生长发育环境因素的相关内容。营养素（A对BCDE错）是儿童体格生长的物质基础。儿童处于迅速成长阶段，需不断从外界摄取各种营养素，包括宏量营养素和微量营养素，以满足生长需要。